催化糖原水解为葡萄糖的酶是
A. 6-磷酸葡萄糖脱氢酶
B. 苹果酸脱氢酶
C. 丙酮酸脱氢酶
D. NADH脱氢酶
E. 葡糖-6-磷酸酶

正确答案：E。葡糖-6-磷酸酶

解析：肝内存在葡糖-6-磷酸酶，可将葡糖-6-磷酸水解成葡萄糖释放入血（E对）。6-磷酸葡萄糖脱氢酶参与磷酸戊糖途径的催化（A错）。苹果酸脱氢酶是一种以NAD+或NADP+为受体、作用于供体CH-OH基团上的氧化还原酶（B错）。丙酮酸脱氢酶参与丙酮酸形成乙酰CoA的阶段（C错）。NADH脱氢酶是一种位于线粒体内膜催化电子从NADH传递给辅酶Q的酶（D错）。